为成人推荐的去除牙颈部及龈沟内的菌斑的有效刷牙方法是
A. 水平颤动法
B. 旋转刷牙法
C. 圆弧刷牙法
D. Fones刷牙法
E. 改良的stillman刷牙法

正确答案：A。水平颤动法

解析：水平颤动拂刷法是一种有效清除龈沟内和牙面菌斑的刷牙方法。水平颤动主要是去除牙颈部及龈沟内的菌斑。掌握“自我口腔保健方法”知识点。